可引起水杨酸反应的药物是
A. 阿司匹林
B. 非那西丁
C. 保泰松
D. 醋氨酚
E. 羟基保泰松

正确答案：A。阿司匹林

解析：阿司匹林不良反应：①胃肠道反应最为常见。②加重出血倾向。③水杨酸反应：阿司匹林剂量过大（5g/d）时，可出现头痛、眩晕、恶心、呕吐、耳鸣、视、听力减退，总称为水杨酸反应，是水杨酸类中毒的表现，严重者可出现过度呼吸、高热、脱水、酸碱平衡失调，甚至精神错乱。④过敏反应：少数患者可出现荨麻疹、血管神经性水肿和过敏性休克。某些哮喘患者服用阿司匹林或其他解热镇痛药后可诱发哮喘，称为“阿司匹林哮喘”。⑤瑞夷综合征。⑥对肾脏的影响。　掌握“阿司匹林”知识点。